经呼吸道静式染毒的主要优点是
A. 操作方便
B. 受试物消耗少
C. 设备简单
D. 适用于小动物急性毒性研究
E. 以上均是

正确答案：E。以上均是